下面所列原穴，错误的是
A. 肝经—太冲
B. 胆经—蠡沟
C. 胃经—冲阳
D. 大肠经—合谷
E. 心经—神门

正确答案：B。胆经—蠡沟

解析：胆经原穴是丘墟第（B错，为本题正确答案）。肝经—太冲（A对），胃经—冲阳（C对），大肠经—合谷（D对），心经—神门（E对）。